下列辅料中，可作为液体药剂防腐剂的有
A. 甘露醇
B. 苯甲酸钠
C. 甜菊苷
D. 羟苯乙酯
E. 琼脂

正确答案：B、D。苯甲酸钠；羟苯乙酯

解析：本题考查液体制剂常用的附加剂。苯甲酸钠（B对）、羟苯乙酯（D对）可作为液体药剂的防腐剂；甘露醇（A错）可作为填充剂、甜味剂；甜菊苷（C错）可作为甜味剂；琼脂（E错）具有凝固性，稳定性，能与一些物质形成络合物等物理化学性质，可用作增稠剂,凝固剂，悬浮剂，乳化剂，保鲜剂和稳定剂。